骨、软骨、筋膜、脂肪、神经等组织游离移植时，应严格控制无菌条件是由于
A. 这些组织血运差
B. 抗菌力弱
C. 易发生感染
D. A+B
E. A+B+C

正确答案：E。A+B+C

解析：整复手术的无菌条件应要求严格，特别是行骨、软骨、筋膜、脂肪、神经等组织游离移植时，尤为重要，因为这些组织血运差、抗菌力弱，易发生感染而导致手术失败。掌握“口腔颌面部后天畸形概论”知识点。